可保护药品免受酶破坏从而提高疗效的联合用药是
A. 阿莫西林+克拉维酸
B. 磺胺甲噁唑+甲氧苄啶
C. 阿司匹林+甲苯磺丁脲
D. 硫酸亚铁+维生素C
E. 氢溴酸山莨菪碱+盐酸哌替啶

正确答案：A。阿莫西林+克拉维酸

解析：本题考查药物的相互作用。可保护药品免受酶破坏从而提高疗效的联合用药是阿莫西林+克拉维酸（A对）。阿莫西林易被细菌的β内酰胺酶水解，克拉维酸是β内酰胺酶不可逆的竞争型抑制剂，阿莫西林与克拉维酸组成复方制剂可保护不耐酶的抗菌药物结构，提高抗菌活性和效果。磺胺甲噁唑与甲氧苄啶两者合用对细菌合成叶酸有双重阻断作用（B错）。阿司匹林与甲苯磺丁脲合用可使后者的游离型药物增加，血浆药物浓度升高（C错）。硫酸亚铁合用维生素C可以促进人体对铁剂的吸收（D错）。氢溴酸山莨菪碱与盐酸哌替啶合用时可增加毒性（E错）。